根据《药品注册管理办法》，甲药品批准文号为国药准字Z20080022，其中Z表示
A. 化学药品
B. 中药
C. 生物制品
D. 进口药品
E. 进口药品分包装

正确答案：B。中药

解析：本题考查的是药品批准文号的格式。根据《药品注册管理办法》，甲药品批准文号为国药准字Z20080022，其中Z表示中药（B对）。药品注册证书载明的药品批准文号的格式：①境内生产药品：国药准字H（Z、S）+四位年号+四位顺序号；②中国香港、澳门和台湾地区生产药品：国药准字H（Z、S）C+四位年号+四位顺序号；③境外生产药品（DE错）：国药准字H（Z、S）J+四位年号+四位顺序号。其中，H代表化学药（A错），Z代表中药，S代表生物制品（C错）。药品批准文号，不因上市后的注册事项的变更而改变。